提示心包积液的体征是
A. Musst征
B. 脉短绌
C. Ewart征
D. Roth斑
E. Duroziz双重音

正确答案：C。Ewart征

解析：Ewart征（C对）即心包积液征，指积液量大时可于左肩胛骨下出现叩浊音，听诊闻及支气管呼吸音，是提示心包积液的体征。Musset征（点头征）（A错）是指头部出现与心跳一致的规律性点头样运动；Duroziez征（Duroziez双重音）（E错）是指以听诊器钟型体件稍加压力于股动脉，并使体件开口方向稍偏向近心端，可在股动脉闻及收缩期与舒张期双期吹风样杂音（九版诊断学P162），这两者常为主动脉瓣关闭不全时出现的周围血管征。脉短绌（P188）（B错）是指脉率小于心率，是心房颤动的典型体征。Roth斑（P309）（D错）为视网膜的卵圆形出血斑，其中心呈白色，为亚急性感染性心内膜炎的常见体征。